关于华法林的描述，错误的是
A. 口服有效
B. 用于血栓性疾病
C. 体内有效
D. 属于香豆素类的抗凝血药
E. 仅体外有效

正确答案：E。仅体外有效

解析：香豆素类是一类含有4-羟基香豆素基本结构的口服抗凝血药，包括华法林等（AD对）。本类药物还具有抑制凝血酶诱导的血小板聚集作用。由于以上原因，香豆素类体外无抗凝作用（C对）（E错，为本题正确答案）。香豆素类如华法林应用于血栓栓塞性疾病，如静脉血栓栓塞、外周动脉血栓栓塞等（B对）。